能治疗癫痫发作而无镇静催眠作用的药物是
A. 地西泮
B. 苯妥英钠
C. 苯巴比妥
D. 扑米酮
E. 以上都不是

正确答案：B。苯妥英钠

解析：能治疗癫痫发作有地西泮、苯妥英钠、苯巴比妥、扑米酮，其中地西泮、苯巴比妥、扑米酮均有镇静催眠作用，而苯妥英钠无镇静催眠作用（B对）。地西泮（A错）属于苯二氮草类，因其明显缩短入睡时间、显著延长睡眠持续时间、减少觉醒次数，是理想的镇静催眠药，同时，地西泮静脉注射是目前治疗癫痫持续状态的首选药物。苯妥英钠（B对）是治疗大发作和局限性发作的首选药物，无镇静催眠作用。苯巴比妥（C错）属于巴比妥类，有镇静催眠作用，但由于久用停药后可“反跳性”地显著延长快动眼睡眠时相，伴有多梦，引起睡眠障碍，因此越来越少用于镇静催眠，同时临床用于治疗癫痫大发作和癫痫持续状态。扑米酮（D错）又名扑痫酮，仅用于其他药物无效的患者，常见的中枢的不良症状包括镇静、催眠。